某女，46岁。症见头痛昏重、胸膈痞闷、脘腹胀痛、呕吐泄泻，舌苔白腻。医师诊断为外感风寒、内伤湿滞证，处以藿香正气滴丸。处方组成：苍术160g、陈皮160g、姜厚朴160g、白芷240g、茯苓240g、大腹皮240g、生半夏160g、甘草浸膏20g、广藿香油1.6ml、紫苏叶油0.8ml。在《新型冠状病毒肺炎诊疗方案（试行第八版）》中，藿香正气滴丸被推荐用于医学观察期乏力伴胃肠不适的病例治疗。上述滴丸含量测定成分为橙皮苷，其化学结构类型是
A. 萜类
B. 挥发油
C. 醛类
D. 黄酮类
E. 苯丙素类

正确答案：D。黄酮类

解析：本题考查的是黄酮类化合物的结构。藿香正气滴丸含量测定成分为橙皮苷，其化学结构类型是黄酮类（D对）。陈皮中除含有挥发油外，还含有多种黄酮类化合物，其中橙皮苷具有和芦丁相同的用途。萜类（A错）化合物是一类数量巨大、结构种类繁多、生物活性多样、具有很高药用价值的天然化学成分，在中药中分布极为广泛。如穿心莲、青蒿、龙胆、紫杉等众多中药的有效成分均为萜类化合物。挥发油（B错）也称精油，是存在于植物体内的一类可随水蒸气蒸馏、与水不相混溶的挥发性油状液体。挥发油大多具有芳香气味，并具有多方面较强的生物活性，为中药所含有的一类重要化学成分。苯丙素类（E错）化合物是由C6-C3构成的一类天然产物，主要包含香豆素和木脂素类化合物。